男，12岁。1个月前无明显诱因出现左胫骨近端肿痛，逐渐加重，皮肤表面静脉怒张，皮温增高。X线片见左胫骨近端呈溶骨性破坏，伴有骨膜日光放射表现。确诊该病的检查方法是
A. CT
B. MRI
C. 组织活检
D. B超
E. 核素扫描

正确答案：C。组织活检

解析：患儿无明显诱因出现左胫骨近端肿痛，逐渐加重，皮肤表面静脉怒张，皮温增高（提示可能为肿瘤），X线片见左胫骨近端呈溶骨性破坏，伴有骨膜日光放射表现（骨肉瘤典型影像学表现），结合患者临床表现及影像学检查，该患者最可能的诊断为左胫骨骨肉瘤。骨肿瘤的诊断须结合临床表现、影像学和病理学检查，其中病理组织活检（C对）可取得病变组织标本，进行染色镜检，为最后确诊的金标准。CT（A错）、MRI（B错）、核素扫描（E错）等影像学检查可辅助骨肿瘤的诊断，为肿瘤的分期、是否有远处转移、治疗及预后的判断提供依据，但不能确诊骨肿瘤。B超（D错）对骨肿瘤诊断价值不大。